下列关于青少年与老年人恒牙髓腔的叙述中，不正确的是
A. 青少年恒牙的髓腔比老年者大
B. 老年人的髓腔根管逐渐变细
C. 青少年恒牙的髓腔髓室大
D. 青少年恒牙的髓腔有继发性牙本质向心性沉积
E. 青少年恒牙的髓腔根管粗

正确答案：D。青少年恒牙的髓腔有继发性牙本质向心性沉积

解析：青少年恒牙的髓腔比老年者大，表现为髓室大、髓角高、根管粗、根尖孔亦大。老年人随着年龄的增长，在髓腔内壁有继发性牙本质向心性沉积，使髓腔的体积逐渐缩小，髓角变低平，根管变细，根尖孔窄小，有的髓腔部分或全部钙化阻塞，给临床治疗带来困难。掌握“髓腔各部分名称、增龄性变化及临床意义”知识点。